暴露与疾病由于有共同的原因而产生的关联是
A. 偶然关联
B. 继发关联
C. 间接因果关联
D. 直接因果关联
E. 统计学关联

正确答案：B。继发关联

解析：本题考查继发关联。暴露与疾病由于有共同的原因而产生的关联是继发关联（B对ACDE错）。